面裂囊肿属于
A. 软组织囊肿
B. 牙源性颌骨囊肿
C. 非牙源性颌骨囊肿
D. 血外渗性囊肿
E. 瘤样病变

正确答案：C。非牙源性颌骨囊肿

解析：面裂囊肿属发育性囊肿，此类囊肿有特定的发生部位和形态，与牙无关。掌握“牙源性颌骨囊肿”知识点。